尿中发现大量透明管型时，提示病变在
A. 肾小管和肾盏
B. 肾小管和肾盂
C. 肾小管和肾小球
D. 肾小管和输尿管
E. 肾小管和膀胱

正确答案：C。肾小管和肾小球

解析：透明管型是由肾单位肾小管上皮细胞分泌的Tamm-Horsfall粘蛋白凝固而形成的，尚有少量清蛋白和氯化物参与。尿流量低、尿液浓缩或酸性环境均可促进透明管型的形成，可见于肾小球或肾小管的病变。少量透明管型可见于发热与运动后。大量透明管型时则要考虑病变存在，常提示病变在肾小管和肾小球（C对）。肾盂、肾盏病变常为化脓性病变，不会导致透明管型，而是形成白细胞管型。输尿管及膀胱病变均不会出现管型。因此，ABDE均为前者病变可导致透明管型，后者病变不可导致，而C选项则二者均可，因此最佳选项为C。